丸剂的质量检查项目包括
A. 溶散时限
B. 软化点
C. 崩解时限
D. 相对密度
E. 融变时限

正确答案：A。溶散时限

解析：本题考查的是丸剂的质量要求。丸剂的质量检查项目包括溶散时限（A对）。丸剂的溶散时限：除另有规定外，小蜜丸、水蜜丸和水丸应在1小时内全部溶散；浓缩丸和糊丸应在2小时内全部溶散；滴丸应在30分钟内全部溶散，包衣滴丸应在1小时内全部溶散。蜡丸照崩解时限检查法片剂项下的肠溶衣片检查法检查，在盐酸溶液中（9→1000）检查2小时，不得有裂缝、崩解或软化现象，再在磷酸盐缓冲液（pH6.8）中检查，1小时内应全部崩解。除另有规定外，大蜜丸及研碎、嚼碎后或用开水、黄酒等分散后服用的丸剂不检查溶散时限。软化点（B错）为膏药的质量检测项目。崩解时限（C错）为胶囊剂、蜡丸与片剂的质量检测项目。相对密度（D错）为合剂与煎膏剂的质量检测项目。融变时限（E错）为栓剂与阴道片的质量检测项目。